符合申请中药二级保护品种的条件是
A. 对特定疾病有特殊疗效的
B. 对特定疾病有显著疗效的
C. 用于预防特殊疾病的
D. 用于治疗特殊疾病的
E. 已申请专利的中药品种

正确答案：B。对特定疾病有显著疗效的

解析：本题考查中药保护品种的等级划分。符合申请中药二级保护品种的条件是对特定疾病有显著疗效的对特定疾病有显著疗效的（B对）。中药保护品种的等级划分：对受保护的中药品种分为一级和二级进行管理。中药一级保护品种的保护期限分别为30年、20年、10年，中药二级保护品种的保护期限为7年。（1）申请中药一级保护品种应具备的条件：符合下列条件之一的中药品种，可以申请一级保护。①对特定疾病有特殊疗效的（A错）；②相当于国家一级保护野生药材物种的人工制成品；③用于预防和治疗特殊疾病的（CD错）。（2）申请中药二级保护品种应具备的条件：符合下列条件之一的中药品种，可以申请二级保护。①符合上述一级保护的品种或者已经解除一级保护的品种；②对特定疾病有显著疗效的；③从天然药物中提取的有效物质及特殊制剂。申请专利的中药品种（E错），依照专利法的规定办理，不适用《中药品种保护条例》。申请专利的中药品种除外。国家药品监督管理部门负责全国中药品种保护的监督管理工作。